与心中静脉伴行的冠状动脉支是
A. 前室间支
B. 左室间支
C. 后室间支
D. 旋支
E. 以上都不对

正确答案：C。后室间支

解析：后室间支（C对）为与起于心尖部的心中静脉伴行的冠状动脉支。